乳癌患者，发现同侧腋下及胸骨旁有淋巴结转移，但一般情况尚可，宜行
A. 乳癌扩大根治术
B. 单纯乳房切除术
C. 乳癌根治术
D. 改良根治术
E. 放疗加化疗

正确答案：A。乳癌扩大根治术

解析：乳癌根治术（C错）主要适用于乳腺外上象限的肿瘤，其切除范围包括：整个乳房、胸大肌、胸小肌、腋窝及锁骨下淋巴结，但并不能处理胸骨旁淋巴结。乳癌扩大根治术适用于乳腺内象限伴胸骨旁淋巴结转移的肿瘤，该术式在乳癌根治术的基础上加切胸廓内动、静脉及胸骨旁淋巴结。单纯乳房切除术（B错）适用于非浸润性癌、微小癌、湿疹样癌限于乳头者以及年迈体弱不宜作根治术者，仅切除乳腺组织、乳头、部分皮肤和胸大肌筋膜。改良根治术（D错）适用于微小癌及临床Ⅰ、Ⅱ期乳腺癌，其切除范围包括整个乳房，保留胸肌并尽量剥离腋窝及胸肌间淋巴结。放疗加化疗（E错）一般作为乳腺癌手术后的辅助治疗或晚期乳腺癌的姑息治疗。该患者一般情况尚可，且存在同侧腋下及胸骨旁有淋巴结转移，宜行乳癌扩大根治术（A对）。